根据《中华人民共和国药品管理法》，药品生产企业可以
A. 经国家药品监督管理部门批准，接受委托生产药品
B. 在保证出厂检验合格的前提下，自主改变药品生产工艺
C. 在库存药品检验合格的前提下，自主延长其库存药品的效期
D. 经企业之间协商一致，接受委托生产药品
E. 采用企业内定的中药饮片炮制规范炮制饮片

正确答案：A。经国家药品监督管理部门批准，接受委托生产药品

解析：本题考查的药品的委托生产。根据《中华人民共和国药品管理法》，药品生产企业可以经国家药品监督管理部门批准，接受委托生产药品（A对）。《中华人民共和国药品管理法》第三十二条规定，药品上市许可持有人可以自行生产药品，也可以委托药品生产企业生产。药品上市许可持有人自行生产药品的，应当依照本法规定取得药品生产许可证；委托生产的，应当委托符合条件的药品生产企业（D错）。中药饮片应当按照国家药品标准炮制；国家药品标准没有规定的，应当按照省、自治区、直辖市人民政府药品监督管理部门制定的炮制规范炮制（E错）。